收湿敛疮宜用
A. 乌梅
B. 桑螵蛸
C. 诃子
D. 椿皮
E. 乌贼骨

正确答案：E。乌贼骨

解析：本题考查的是海螵蛸的功效。收湿敛疮宜用乌贼骨（E对）。乌贼骨为海螵蛸的别名。海螵蛸：【功效】收敛止血，固精止带，制酸止痛，收湿敛疮。乌梅（A错）：【功效】敛肺，涩肠，生津，安蛔，止血。桑螵蛸（B错）：【功效】固精缩尿，补肾助阳。诃子（C错）：【功效】涩肠，敛肺，下气，利咽。椿皮（D错）：【功效】清热燥湿，涩肠，止血，止带，杀虫。